针刺皮肤松弛部位的腧穴，最适宜选用的进针方法
A. 指切进针法
B. 夹持进针法
C. 舒张进针法
D. 提捏进针法
E. 以上都不是

正确答案：C。舒张进针法

解析：松弛部位的皮肤进针时，需要把皮肤绷紧后再进针，宜选用舒张进针法（C对）。指切进针法适用于短针的进针（A错）；夹持进针法适用于长针的进针（B错）；提捏进针法主要用于印堂穴等皮肉浅薄部位的腧穴（D错）。